慢性胰腺炎最突出的症状是
A. 呕吐
B. 发热
C. 腹部包块
D. 便秘
E. 腹痛

正确答案：E。腹痛

解析：慢性胰腺炎是各种原因所致的胰实质和胰管的不可逆慢性炎症，其最突出的症状是反复发作的上腹痛（E对）伴不同程度的胰腺内、外分泌功能减退或丧失。内分泌功能减退的表现：血糖升高（胰腺β细胞破坏）；外分泌功能减退的表现：食欲减退、呕吐（A错）、腹泻或脂肪泻（D错）、水肿、营养不良等。最突出的症状是与腹痛不相称的腹部轻压痛，当并发胰腺假性囊肿时，可扪及腹部包块（C错）。慢性胰腺炎也可出发热（B错），但不是最突出的症状。